对于突然意识丧失、大动脉搏动消失的患者，应立即施行的抢救措施是开始
A. 气道
B. 开放静脉
C. 胸外按压
D. 注射肾上腺素
E. 人工呼吸

正确答案：C。胸外按压

解析：对于突然意识丧失、大动脉搏动消失的患者，应立即施行的抢救措施是开始胸外按压（C对），对于心脏骤停的患者应立即采取初级心肺复苏，其中首先进行的措施是人工胸外按压，然后是开通气道（A错）和人工呼吸（E错）。开放静脉（B错）及注射肾上腺素（D错）属于高级生命措施。